《素问·调经论》的病因分类法是
A. 阴阳
B. 内外
C. 寒热
D. 表里
E. 脏腑

正确答案：A。阴阳

解析：《内经》将病因与发病相结合，明确分为阴阳两大类，即来自于自然界气候异常变化，多伤人外部肌表的，归属于阳邪；凡饮食不节，居处失宜，起居无常，房事失度，情志过激，多伤人内在脏腑精气的，归属于阴邪（A对）。除此之外，《内经》还提出了病因的三部分类法，如《灵枢·百病始生》说：“夫百病之始生也，皆生于风雨寒暑，清湿喜怒。喜怒不节则伤脏，风雨则伤上，清湿则伤下。三部之气，所伤异类。”